引继发性腹膜炎的细菌主要是
A. 变形杆菌
B. 大肠埃希菌
C. 肺炎链球菌
D. 铜绿假单胞杆菌
E. 拟杆菌

正确答案：B。大肠埃希菌

解析：继发性腹膜炎是最常见的腹膜炎，其致病菌主要是大肠埃希菌（B对），而变形杆菌（A错）、铜绿假单胞杆菌（D错）和拟杆菌（E错）都较少见。肺炎链球菌（C错）是血行播散引起的原发性腹膜炎的主要致病菌。